反应激动药与受体亲和力大小的是
A. pD₂
B. pA₂
C. Cmax
D. α
E. tmax

正确答案：A。pD₂

解析：本题考查作用于受体药物的分类。反应激动药与受体亲和力大小的是pD₂（A对）。激动药与受体的亲和力用亲和力指数pD₂表示。pA₂（B错）用来表示竞争性拮抗药与受体的亲和力。Cmax（C错）表示峰浓度。α（D错）表示内在活性。tmax（E错）表示达峰时间。